属于分段线性函数的环境质量指数是
A. Brown水质指数
B. I₁大气质量指数
C. I₂污染超标指数
D. AQI指数
E. 水质综合污染指数

正确答案：D。AQI指数

解析：本题考查属于分段线性函数的环境质量指数。AQI指数（D对ABCE错）即空气质量指数，各分指数与其实测浓度呈分段线性函数关系，属于分段线性函数的环境质量指数。